女性，44岁，反复发作上腹部疼痛3年，近3天上腹绞痛，伴发热寒颤，皮肤巩膜黄染。若病人出现神志淡漠嗜睡，最有效的治疗措施是
A. 纠正水、电解质和酸碱平衡紊乱
B. 给予有效足量抗生素
C. 应用肾上腺皮质激素
D. 紧急手术解除胆道梗阻并减压引流
E. 使用多巴胺等药物维持血压

正确答案：D。紧急手术解除胆道梗阻并减压引流

解析：中年女性，3天来腹痛、寒战高热、黄疸（Charcot三联征，继发胆管炎典型表现），若病人出现神志淡漠、嗜睡（中枢神经系统受抑制），则符合Reynolds五联征（急性梗阻性化脓性胆管炎典型表现；腹痛、寒战高热、黄疸、中枢神经系统受抑制、休克）的表现。根据病史及临床表现，应诊断为急性梗阻性化脓性胆管炎。急性梗阻性化脓性胆管炎的发病基础是胆道梗阻及细菌感染。如果在疾病发展过程中，胆道梗阻不能解除，胆管内细菌引起的感染得不到控制，将会危及患者生命，最有效的治疗措施是紧急手术解除胆道梗阻并减压引流（D对）。纠正水电解质和酸碱平衡紊乱（A错）可使内环境更加正常；给予有效足量抗生素（B错）可抗菌，但二者均属于一般性治疗措施。应用肾上腺皮质激素（C错）可以增强患者对刺激的耐受能力，但此时患者中枢神经系统已经受抑制，此措施作用不大。患者若休克，最大可能是感染性休克，需要马上去除感染病灶并大量补液来促使患者苏醒，而不是使用多巴胺等药物维持血压（E错）。